T细胞具备对各种抗原的特异性细胞免疫应答能力的胎龄是
A. 5周
B. 10周
C. 20周
D. 30周
E. 40周

正确答案：E。40周

解析：T细胞来自胚胎和骨髓的淋巴干细胞，于胎龄8周时移行至胚胎胸腺，获得T细胞受体，并在其发育成熟。胎龄13周起，先后出现对同种异型移植物的排斥反应。于胎龄40周（E对）时具备对各种抗原的特异性细胞免疫应答能力。